霍乱流行型以哪种为主要表现
A. 暴发和流行
B. 持续散发型
C. 暴发型与持续散发型并存
D. 以持续散发型为主，兼有暴发型
E. 以暴发型为主，兼有持续散发型

正确答案：A。暴发和流行